关于釉柱的叙述，下列说法错误的是
A. 呈细长形柱状结构
B. 起自釉牙本质界，到达牙表面
C. 窝沟处釉柱呈放射状
D. 近牙颈部呈水平状排列
E. 直径在深部较表面为大

正确答案：E。直径在深部较表面为大

解析：釉柱是细长的柱状结构，起自釉牙本质界，贯穿釉质全层而达牙的表面。其走行方向反映了成釉细胞形成釉质时向后退缩的路线。在窝沟处，釉柱由釉牙本质界向窝沟底部集中，呈放射状；而在近牙颈部，釉柱排列几乎呈水平状。由于釉质表面积比釉牙本质界宽大，因此釉柱的直径在表面者较深部者为大。掌握“牙釉质”知识点。